男，45岁。乏力、纳差、眼黄、尿黄6天入院。病前2个月外出旅游20多天多在餐馆进餐及进食生冷食物。实验室检查：ALT860U/L，AST620U/L，TBil260μmol/L，DBil260μmol/L，PTA85%。为明确诊断，应追问的病史不包括
A. 饮酒史
B. 服用损肝药物药物史
C. 输血史
D. 既往肝炎病史
E. 宠物接触史

正确答案：E。宠物接触史

解析：患者男性，乏力、纳差、眼黄（巩膜黄染，黄疸的表现）、尿黄。病前两个月外出旅游20天多在餐馆进食及进食生冷食物（不洁饮食史）。实验室检查：ALT860U/L（谷丙转氨酶，正常值＜45U/L），AST620U/L（谷草转氨酶，正常值＜50U/L），TBil260μmol/L（总胆红素，正常值1.71-17.1μmol/L），DBil260μmol/L（直接胆红素，正常值1.71-7μmol/L）升高，以上数值均升高提示肝功能受损且有胆汁淤积。PTA85%（凝血酶原活动度，正常值75%-100%，其可反映肝脏储备，合成功能，和疾病严重程度呈正相关），根据患者病史临床体征和实验室检查拟诊断为急性肝炎。追问病史应追问与肝损害有关的病史，饮酒史（A对）、服用损肝药物史（B对）、输血史（C对）、既往肝炎病史（D对）均符合，而宠物接触史（E错，为本题正确答案）与此病关系不大。